小儿生长发育最迅速的时期是
A. 婴儿期
B. 幼儿期
C. 学龄前期
D. 学龄期
E. 青春期

正确答案：A。婴儿期

解析：人生长发育是连续的、有阶段性的过程，有婴儿期和青春期两个生长高峰。身长和体重在出生后第一年（婴儿期），尤其是前三个月增加很快，身长由50cm增加至75cm为出生时的1.5倍，体重增加至10kg为出生时3倍（A对）。出生后第二年开始生长速度逐渐减慢，至青春期生长速度又加快，其中女孩身高平均每年增加8～9cm，男孩9～10cm。可见青春期儿童发育速度速度不及婴儿期（E错）。